治疗湿热腰痛，应首选
A. 甘姜苓术汤
B. 四妙丸
C. 羌活胜湿汤
D. 薏苡仁汤
E. 乌头汤

正确答案：B。四妙丸

解析：腰痛寒湿腰痛治宜散寒行湿，温经通络，方选甘姜苓术汤（A错）。腰痛湿热腰痛治宜清热利湿，舒筋止痛，方选清热利湿、舒筋壮骨的四妙丸（B对）。痉证邪壅经络证治宜祛风散寒，燥湿和营，方选羌活胜湿汤（C错）。痹证风寒湿痹之着痹治宜除湿通络，祛风散寒，方选薏苡仁汤（D错）。痹证风寒湿痹之痛痹治宜散寒通络，祛风除湿，方选乌头汤（E错）。